子宫内膜癌的癌前期改变的是
A. 萎缩型子宫内膜
B. 子宫内膜腺囊型增生过长
C. 黄体功能不全
D. 黄体萎缩不全
E. 子宫内膜非典型性增生

正确答案：E。子宫内膜非典型性增生

解析：子宫内膜癌有两种发病类型Ⅰ型为雌激素依赖型，其发生可能是在无孕激素拮抗的雌激素长期作用下，发生子宫内膜增生症，继而癌变；Ⅱ型为非雌激素依赖型，发病与雌激素无明确关系。子宫内膜非典型性增生发生子宫内膜腺癌的几率为23%，综上，子宫内膜癌的癌前期改变的是子宫内膜非典型性增生（E对）。子宫内膜腺囊型增生过长又称为单纯型增生（B错）发展为子宫内膜腺癌的几率仅为1%。萎缩型子宫内膜（A错）、黄体功能不全（C错）、黄体萎缩不全（D错）均不会发展成为子宫内膜腺癌。